服用环孢素不宜同食
A. 葡萄柚汁
B. 咖啡
C. 食醋
D. 高蛋白
E. 高脂肪

正确答案：A。葡萄柚汁

解析：本题考查饮食对药物疗效的影响。服用环孢素不宜同食葡萄柚汁（A对）。葡萄柚汁主要影响CYP3A4代谢，同时抑制CYP3A4的活性。咖啡（B错）可以刺激胃液和胃酸分泌，有胃溃疡或胃酸过多的人不宜饮用。食醋（C错）不宜与磺胺药同服，后者在酸性条件下溶解度降低，可在尿道中形成磺胺结晶。高蛋白（D错）食物在肠内产生大量氨基酸，阻碍左旋多巴的吸收，使药效降低。高脂肪（E错）食物可促进胆汁的分泌，延缓胃排空的速度，增加灰黄霉素的吸收。